单室模型静脉滴注给药过程中，血药浓度与时间的计算公式是
A. MRT=AUMC/AUC
B. Css=K₀/KV
C. fss=1-e-kt
D. C=K₀（1-e-kt）/KV
E. E=dXu/dt=ke·X₀e-kt

正确答案：D。C=K₀（1-e-kt）/KV

解析：本题考查单室模型静脉滴注给药。C=K₀（1-e-kt）/KV（D对）为单室模型静脉滴注给药血药浓度C与时间t的关系式；MRT=AUMC/AUC（A错）为药物在体内的平均滞留时间；Css=K₀/KV（B错）为稳态血药浓度定义式； fss=1-e-kt（C错）为达坪分数定义式；E=dXu/dt＝ke·X₀e-kt（E错）为尿排泄速度与时间的关系公式。